呕吐肝气犯胃的最佳方
A. 四七汤
B. 柴胡疏肝散合左金丸
C. 半夏厚朴汤
D. 旋覆代赭汤
E. 半夏厚朴汤合左金丸

正确答案：A。四七汤

解析：肝气犯胃临床表现为呕吐吞酸，或干呕泛恶，脘胁胀痛，烦闷不舒，嗳气频频，每遇情志失调而发作或加重，舌边红，苔薄腻或微黄，脉弦。病机为肝失疏泄，横逆犯胃，胃失和降。治宜疏肝和胃，降逆止呕。四七汤与半夏厚朴汤合左金丸加减均能够治疗呕吐肝气犯胃证，根据目前最新版本中医执业医师指导用书，选择四七汤（A对E错）。柴胡疏肝散疏肝理气，为肝气郁滞证之胁痛的代表方（B错）。半夏厚朴汤行气开郁，化痰散结，为痰气郁结证之郁证的代表方（C错）。旋覆代赭汤降逆化痰，益气和胃，主治胃气虚弱，痰浊内阻（D错）。